孕妇服用己烯雌酚保胎引起的严重不良反应为
A. 成年后易发阴道癌
B. 心脏毒性
C. 皮肤反应
D. 心血管反应
E. 周围神经炎

正确答案：A。成年后易发阴道癌

解析：本题考查药物不良反应。孕妇用己烯雌酚保胎易导致所生女婴成年后发生阴道腺癌（A对）。